血清间接胆红素增加，直接胆红素基本正常见于
A. 肝外胆管梗阻
B. 急性血管内溶血
C. 肝细胞反复炎症
D. Dubin-Johnson综合征
E. 肝内胆管梗阻

正确答案：B。急性血管内溶血

解析：急性血管内溶血（B对）时，大量红细胞破坏，大量间接胆红素生成，而肝细胞摄取间接胆红素转变成直接胆红素需要时间，急性期并无直接胆红素升高，血清间接胆红素增加，直接胆红素基本正常。肝内、肝外胆管梗阻（AE错）时，肝内直接胆红素排出受阻，血直接胆红素升高，血间接胆红素上升或不变。肝细胞反复炎症（C错），肝细胞摄取间接胆红素能力下降，血间接胆红素上升，肝细胞受损破裂，细胞内直接胆红素进入血液，血直接胆红素升高。Dubin-Johnson综合征（慢性特发性黄疸）（C错），血清直接胆红素轻中度增高，间接胆红素正常（C错）。